不属于预防医学的道德要求的是
A. 爱岗敬业，宣传卫生法规，言传身教
B. 改善工作和学习环境，严把防疫和食品卫生规范
C. 严格监管、控制污染，保护生态环境，促进社会文明，科学严谨，实事求是，信息透明公开
D. 防疫工作者有权在疫区切断传染病传播途径的各种措施
E. 提高社区服务水平，保障妇女儿童和老年人权益

正确答案：D。防疫工作者有权在疫区切断传染病传播途径的各种措施

解析：预防医学的道德要求：1.爱岗敬业（A对），奉献实干，献身预防：2.宣传大卫生观，贯彻预防为主的理念（A对）：3.健康教育中言传身教（A对），提倡健康和行为习惯双向互动的道德责任：4.改善工作和学习环境（B对），关怀劳动场所和学校卫生水平：5.提高社区卫生服务水平，保障妇女儿童和老年人的健康权益（E对）：6.严把防疫与食品卫生关（B对），控制人群疾病发生的社会责任：7.严格监管，控制污染，保护生态环境，促进社会文明（C对）：8.科学严谨，实事求是，信息透明公开（C对），尊重民众知情权：9.清正廉洁，秉公执法，守护健康，甘于做幕后英雄。因此，防疫工作者有权在疫区切断传染病传播途径的各种措施不属于预防医学的道德要求，且在疫区切断传染病传播途径应由政府组织力量进行防治（D错，为本题正确答案）。